虚寒证月经后期的最佳治法是
A. 扶阳祛寒调经
B. 祛寒除湿调经
C. 散寒祛瘀调经
D. 温补肾阳调经
E. 温中散寒调经

正确答案：A。扶阳祛寒调经

解析：月经后期虚寒证，素体阳虚或久病伤阳，阳虚内寒，脏腑失于温养，生化失期，气虚血少，冲任亏虚，血海不能如期满溢，遂致经行后期，治以扶阳驱寒调经（A对）。